对乙酰氨基酚具有
A. 镇痛作用
B. 抗炎作用
C. 两者皆有
D. 两者皆无

正确答案：A。镇痛作用

解析：本题考查对乙酰氨基酚的作用。对乙酰氨基酚为非甾体类抗炎药，其解热作用和镇痛（A对）作用较强，几乎不具有抗炎（B错）和抗风湿作用，临床用于感冒发热、关节痛、头痛、神经痛和肌肉痛等。